患者男，32岁。发热，寒战，会阴部胀痛不适，小腹隐痛，肛门坠胀，尿频尿急尿痛，前列腺压痛。应首先考虑的中医诊断是
A. 子痈
B. 子痛
C. 石淋
D. 精浊
E. 癃闭

正确答案：D。精浊

解析：患者男性，32岁，中青年，为好发人群，出现发热寒战的全身症状，会阴部胀痛不适，小腹隐痛的局部症状，肛门坠胀的直肠症状，尿频尿急尿痛的尿路症状，前列腺压痛应诊断为精浊（D对）。“子痈”属于睾丸炎范畴，急性非特异性睾丸炎多发于单侧。睾丸肿痛，程度由轻微不适到剧烈疼痛不等，向腹股沟放射，阴囊皮肤发红、肿胀。伴寒战、高热、恶心呕吐等。可有头痛，肌肉酸痛。2.慢性非特异性睾丸炎可由急性迁延而来，也可无急性期。因长期轻度感染而形成，临床表现为局部不适，睾丸呈均匀轻度增大，发硬与皮肤不粘连，输精管正常或稍发硬。局部体检：睾丸呈慢性肿大，质硬而表面光滑，有轻触痛，失去正常的敏感度。有的睾丸逐渐萎缩，严重者几乎找不到睾丸，显示附睾相对增大，多数病例炎症由附睾蔓延至睾丸，二者界限不清（A错）。附睾炎属于“子痛”范畴，急性附睾炎全身症状以起病急、发热、寒战为主；局部症状以附睾肿大、疼痛、灼热，疼痛放射至下腹部及腹股沟为特征（B错）。泌尿系结石属于“石淋”范畴，分为肾结石、输尿管结石、膀胱结石、尿道结石（C错）。前列腺增生当属中医“癃闭”范畴，男性50岁后出现进行性尿频、排尿困难，应当考虑前列腺增生的可能。诊断要点：有的患者可出现充溢性尿失禁、急性尿潴留、血尿。老年患者虽无明显排尿困难，但有膀胱结石、膀胱炎、肾功能不全时，也应注意有无前列腺增生。结合直肠指检及其他体征、各项实验室检查可得出诊断（E错）。